口腔单纯性疱疹病毒传染途径
A. 飞沫
B. 唾液
C. 疱疹液
D. 产道
E. 以上均是

正确答案：E。以上均是

解析：本题考查口腔单纯性疱疹病毒的传染途径。单纯疱疹是由单纯疱疹病毒所致的皮肤黏膜病，临床上以出现簇集性小水疱为特征，有自限性，易复发，单纯疱疹病毒是发现最早的人类疱疹病毒，当形成小疱的病毒呈为Ⅰ型疱疹病毒，将形成大疱的病毒为Ⅱ型疱疹病毒。通过飞沫（A对）、唾液（B对）、疱疹液（C对）、产道（D对）均为口腔单纯性疱疹病毒的传染途径，（ABCD均对，故E对为本题的正确答案）。